社区儿童保健的实施原则不包括
A. 社区参与原则
B. 公平原则
C. 以健康为中心提供一揽子服务
D. 低投入高产出
E. 自愿原则

正确答案：E。自愿原则

解析：本题考查社区儿童保健的原则。自愿原则（E错，为本题正确答案）是中国民法的基本原则之一。开展社区儿童保健的原则：①社区参与原则（A对）；②公平原则（B对）；③以健康为中心提供一揽子服务原则（C对）；④低投入高产出原则（D对）。